下述各项，不属于水肿风水相搏证临床表现的是
A. 起病前常有感冒咽痛
B. 水肿从眼睑颜面先起
C. 浮肿向全身蔓延迅速
D. 尿量减少常可见尿血
E. 浮肿重按之凹陷难起

正确答案：E。浮肿重按之凹陷难起

解析：水肿风水相搏证为阳水证型，临床表现为眼睑浮肿，继则四肢及全身皆肿（B对，），来势迅速（C对），多有恶寒，发热等症。偏于风热者，伴咽喉红肿疼痛；偏于风寒者，兼恶寒，咳喘（A对，）。文中虽未明显提出D项，但阳水按之凹陷即起，阴水按之凹陷不易恢复（E错，为本题正确答案）。